女，35岁，半年前母突然病故，此后失眠情绪低沉，不愿与人交往。近三个月来独处时常听见有声音对她讲话，说母亲病故与某人有关，故多次给公安机关写信反映母亲被害之事，后来又感到自己的思维情感不由自己支配，自己的想法还未说出已人人皆知，常独自哭泣。神经系统检查未见异常，有慢性肝炎病史3年，目前肝功ALT80U/L。该患者最可能的诊断是
A. 抑郁症伴精神病性症状
B. 反应性精神病
C. 神经衰弱
D. 精神分裂症伴抑郁症状
E. 躯体疾病所致精神障碍

正确答案：D。精神分裂症伴抑郁症状

解析：该病例为青年女性，时常听到有声音对她讲话（言语性幻听）、自己的想法还未说出已人人皆知（思维被洞悉妄想）为主要表现，且近三个月来独处（在妄想、幻觉的支配下的表现行为），诊断精神分裂症，伴有失眠情绪低沉，常独处暗自哭泣（伴抑郁症状），故最可能诊断为精神分裂症伴抑郁症状（D对）。反应性精神病有明显的精神刺激，精神症状内容可以被理解，而本例表现为对象渐趋泛化，内容日益荒诞的妄想，内容无法理解，故不考虑（B错）。